女性，27岁，主诉全口牙龈肿胀、出血不止、疼痛明显3天。口腔检查：全口牙龈肿大波及牙间乳头、边缘龈和附着龈，颜色苍白，龈缘处有坏死溃疡，局部有渗血。口腔黏膜上可见出血点，为了进一步明确诊断还应做的检查是
A. 探诊牙周袋
B. 叩诊
C. X线片检查
D. 血常规检查
E. 进行细菌学检查

正确答案：D。血常规检查

解析：本题考查口腔检查。白血病的牙龈病损可波及龈乳头、龈缘和附着龈。主要表现为：1.牙龈肿大,颜色暗红发绀或苍白，组织松软脆弱或中等硬度，表面光亮。牙龈肿胀常为全口性，且可覆盖部分牙面。由于牙龈肿胀、菌斑堆积,牙龈一般有明显的炎症。2.由于牙龈中大量幼稚血细胞浸润积聚，可造成末梢血管栓塞，局部组织对感染的抵抗力降低，使龈缘处组织坏死,溃疡和假膜形成，状如坏死性溃疡性龈炎，严重者坏死范围广泛，有口臭。3.牙龈有明显的出血倾向，龈缘常有渗血，且不易止住，牙龈和口腔黏膜上可见出血点或淤斑。患者常因牙龈肿胀、出血不止或坏死疼痛而首先到口腔科就诊。及时检查血象有助于诊断（D对）。④严重的患者还可出现口腔黏膜的坏死或剧列的牙痛(牙髓腔内有大量幼稚血细胞浸润引起)、发热、局部淋巴结肿大以及疲乏、贫血等症状。